医疗机构对有能力诊治的危重患者，应当采取的处置措施是
A. 办理住院手续
B. 联系家属
C. 抢救
D. 催促家属缴费
E. 转向上级医院

正确答案：C。抢救

解析：医疗机构对于有能力诊治的病人应当立即抢救（C对），而对于限于设备或技术条件不能诊治的病人，应及时转向上级医院。